关于ARB类药物作用特点及临床应用的说法，错误的是
A. 能够阻断不同途径生成的AngⅡ与AT₁受体结合
B. 对心脏、血管、肾脏的药理作用与ACEI类药物相似
C. 作用持续时间在24小时以上
D. 可导致缓激肽、P物质堆积，引起咳嗽
E. 不推荐与ACEI类药物联用

正确答案：D。可导致缓激肽、P物质堆积，引起咳嗽

解析：本题考查ARB类药物作用特点及临床应用。导致缓激肽、P物质堆积，引起咳嗽等不良反应（D错，为本题正确答案）的是ACEI类药，ARB类药物一般无咳嗽、血管神经水肿的不良反应。